有增生的肉芽的是
A. 弥散性钙化
B. 髓石
C. 牙髓炎
D. 根尖周炎
E. 牙髓息肉

正确答案：E。牙髓息肉

解析：本题考查牙髓病。有增生的肉芽的是牙髓息肉（E对）。患牙大而深的龋洞中有红色、“蘑菇”形状的肉芽组织，又称“牙髓息肉”，它可充满整个洞内并达咬合面，探之无痛但极易出血。